瘀血阻络证胁痛的代表方是
A. 六味地黄丸
B. 一贯煎
C. 柴胡疏肝散
D. 龙胆泻肝汤
E. 血府逐瘀汤

正确答案：E。血府逐瘀汤

解析：瘀血阻络证之胁痛是由瘀血内停，肝络痹阻所致，治宜祛瘀通络，方用血府逐瘀汤或复元活血汤（E对）。六味地黄丸功能滋阴补肾，为治疗癃闭之肾阴亏耗证的选方（A错）。一贯煎为肝络失养证之胁痛的代表方（B错）。柴胡疏肝散为肝气郁滞证之胁痛的代表方（C错）。龙胆泻肝汤为肝胆湿热证之胁痛的代表方（D错）。